三焦的生理功能是
A. 调畅气机
B. 宣发肃降
C. 通行元气
D. 传化水谷
E. 化生精气

正确答案：C。通行元气

解析：三焦的主要生理功能是运行津液和通行元气（C对）。肝主疏泄，指肝具有维持全身气机疏通畅达，通而不滞，散而不郁的生理功能（A错）。肺主通调水道，指通过肺气宣发肃降对体内水液的输布、运行和排泄具有疏通和调节作用（B错）。六腑的生理功能是“传化物”，即受盛和传化水谷（D错）。人体的脾主运化，化生精气血津液，以奉生身（E错）。